以下关于深二度烧伤的情况哪项是正确的
A. 伤及全部真皮及其附件
B. 愈合后留有明显瘢痕
C. 创面感觉敏锐，疼痛剧烈
D. 1周内可愈合
E. 有较小的水疱，创面浅红，拔毛有痛

正确答案：E。有较小的水疱，创面浅红，拔毛有痛

解析：深Ⅱ°烧伤：伤及皮肤的真皮乳头层以下，但仍残留部分网状层，深浅不尽一致，也可有水疱，但去疱皮后创面微湿，红白相间或苍自，痛觉较迟钝（E对）。Ⅲ°烧伤：为全层皮肤烧伤，甚至达到皮下、肌肉或骨骼。创面无水疱，呈蜡白或焦黄色，甚至炭化，痛觉消失（A错）。深二度和三度均可留有明显瘢痕（B错）。浅二度创面感觉敏锐，疼痛剧烈与一度灼烧地样疼痛鉴别（C错）。1周内可愈合是一度（D错）"。